服药后，需啜热稀粥的方剂是
A. 麻黄汤
B. 十枣汤
C. 桂枝汤
D. 败毒散
E. 归脾汤

正确答案：C。桂枝汤

解析：桂枝汤方既为治疗外感风寒表虚证之基础方，又是调和营卫、调和阴阳法之代表方。以恶风，发热，汗出，脉浮缓为辨证要点。本方的服法首先是“适寒温”，“服已须臾，啜热稀粥”（C对），借水谷之精气，充养中焦，不但易为酿汗，更可使外邪速去而不致重感。同时“温覆令一时许”，即是避风助汗之意。待其“遍身哲哲微似有汗”，是肺胃之气已和，津液得通，营卫和谐，腠理复固，故云“益佳”。至于服后汗出病瘥，停后服；或不效，再服；以及禁生冷黏腻、酒肉、臭恶等，尤其是“不可令如水流漓，病必不除”等均为服解表剂应该注意之通则。